男，50岁。颈后肿痛5天，疼痛逐渐加重，伴畏寒、发热。有糖尿病史10年。查体：颈后红肿，范围约5cm，边界不清，中央多个脓点。该患者最可能的诊断是
A. 皮脂腺囊肿感染
B. 颈部丹毒
C. 颈部痈
D. 颈部疖
E. 蜂窝织炎

正确答案：C。颈部痈

解析：中年男性患者。颈后肿痛5天，疼痛逐渐加重，伴畏寒、发热（痈常见伴随症状）。有糖尿病史10年（提示糖尿病史）。查体：颈后红肿（痈好发部位），范围约5cm，边界不清，中央多个脓点（痈常见症状）。结合患者的症状、体查，该患者最可能的诊断是颈部痈（C对）。皮脂腺囊肿感染（A错）由皮脂腺排泄管阻塞所致，好发于头面、颈项部，一般无自觉症状。颈部丹毒（B错）为乙型溶血性链球菌感染所致的急性非化脓性炎症，表现为片状皮肤红疹、微隆起、色鲜红、境界较清楚。颈部疖（D错）是由单个毛囊及周围组织的急性细菌性化脓性炎症，肿块多＜2cm。蜂窝织炎（E错）初起时患处红、肿、热、痛，随之可出现小水泡。